男，72岁。间断咳嗽、咳痰20余年，加重伴喘憋1周。近2天出现嗜睡。查体：意识模糊，口唇发绀，球结膜水肿，双肺满布哮鸣音，双下肢水肿。该患者出现意识障碍最主要机制是
A. 感染中毒性脑病
B. 组织缺氧
C. 电解质紊乱
D. CO₂潴留
E. 脑出血

正确答案：D。CO₂潴留

解析：患者老年男性，72岁。间断咳嗽、咳痰20余年（慢性阻塞性肺疾病），加重伴憋喘1周，近两天出现嗜睡（COPD急性加重期）。查体：意识模糊，口唇发绀，双肺布满哮鸣音，双下肢水肿，说明患者COPD病情恶化，处于急性加重期，出现意识模糊，CO₂潴留（D对）是导致阻塞性肺疾病病情加重的主要原因，并可因高CO₂导致呼吸系统受到抑制，加重脑缺氧（肺性脑病），出现意识障碍。感染中毒性脑病（A错）可以出现意识障碍，但并不是COPD急性加重期出现意识障碍最主要机制。组织缺氧（B错）时，机体代偿优先对重要脏器（大脑、心脏）进行供氧，不会两天即出现意识障碍。COPD急性加重期可以因缺氧导致机体代谢紊乱，出现电解质紊乱（C错），但并不是意识障碍的原因。脑出血（E错）可以出现意识障碍，但是本题提示为COPD患者，出现病情加重导致出现的意识障碍，与脑出血无直接关系。